牡丹皮升华物的结晶滴加三氯化铁醇溶液后
A. 结晶变为紫红色
B. 结晶溶解而显暗紫色
C. 结晶变为绿色
D. 结晶溶解而显鲜绿色
E. 结晶溶解而显棕黄色

正确答案：B。结晶溶解而显暗紫色

解析：本题考查的是牡丹皮的理化鉴别。牡丹皮升华物的结晶滴加三氯化铁醇溶液后结晶溶解而显暗紫色（B对）。牡丹皮【理化鉴别】取粉末进行微量升华，升华物在显微镜下呈长柱形、针状、羽状结晶，于结晶上滴加三氯化铁醇溶液，则结晶溶解而显暗紫色。（检查丹皮酚）